《中国药典》收载的生脉饮为口服液，其处方由红参、麦冬和五味子组成。具有益气复脉、养阴生津之功效。制备生脉饮口服液时可加适量防腐剂，允许选用的品种和用量是
A. 羟苯乙酯，≤0.10%
B. 山梨酸，≤0.30%
C. 羟苯丙酯，≤0.30%
D. 苯甲酸，≤0.35%
E. 羟苯甲酯，≤0.35%

正确答案：B。山梨酸，≤0.30%

解析：本题考查的是合剂的质量要求。制备生脉饮口服液时可加适量防腐剂，允许选用的品种和用量是山梨酸，≤0.30%（B对）。合剂系指中药饮片用水或其他溶剂，采用适宜的方法提取、制成的口服液体制剂，其中单剂量灌装者也可称为口服液。合剂可以根据需要加入适宜的附加剂。如需加入抑菌剂，除另有规定外，在制剂确定处方时，该处方的抑菌效力应符合《中国药典》抑菌效力检查法的规定，山梨酸和苯甲酸的用量不得超过0.3%（D错）（其钾盐、钠盐的用量分别按酸计），羟苯酯类的用量不得超过0.05%（ACE错），如加入其他附加剂，其品种与用量应符合国家标准的有关规定，不影响成品的稳定性，并应避免对检验产生干扰。必要时可加入适量的乙醇。除另有规定外，合剂应密封，置阴凉处贮存。